临床最常见的颞下颌关节脱位
A. 颞下颌关节复发性脱位
B. 颞下颌关节急性前脱位
C. 颞下颌关节急性后脱位
D. 颞下颌关节陈旧性脱位
E. 颞下颌关节强直

正确答案：B。颞下颌关节急性前脱位

解析：急性前脱位是临床最常见的颞下颌关节脱位。掌握“颞下颌关节脱位”知识点。